关于经营者履行“三包”或其他责任义务的说法，错误的是
A. 经营者提供的商品不符合质量要求的，消费者可以依照国家规定退货
B. 经营者提供的商品不符合质量要求的，经营者应当承担退货运输等必要费用
C. 消费者采用邮购方式购买的商品若不满意退货，商品的运费由消费者承担费
D. 经营者采用邮购方式销售商品，消费者有权自收到商品十日内无理由退货

正确答案：D。经营者采用邮购方式销售商品，消费者有权自收到商品十日内无理由退货

解析：本题考查经营者的义务。经营者采用网络、电视、电话、邮购等方式销售商品，消费者有权自收到商品之日起七日内退货（D错，为本题正确答案）。经营者应履行“三包”或其他责任的义务：经营者提供的商品或者服务不符合质量要求的，消费者可以依照国家规定、当事人约定退货（A对），或者要求经营者履行更换、修理等义务。没有国家规定和当事人约定的，消费者可以自收到商品之日起七日内退货；七日后符合法定解除合同条件的，消费者可以及时退货，不符合法定解除合同条件的，可以要求经营者履行更换、修理等义务。依照规定进行退货、更换、修理的，经营者应当承担运输等必要费用（B对）。经营者采用网络、电视、电话、邮购等方式销售商品，消费者有权自收到商品之日起七日内退货，除法律规定的情形外，无需说明理由。经营者应当自收到退回商品之日起七日内返还消费者支付的商品价款。退回商品的运费由消费者承担（C对）；经营者和消费者另有约定的，按照约定。